对于牙周炎致病性最强的是
A. 龈上菌斑
B. （牙合）创伤
C. 附着性龈下菌斑
D. 非附着性龈下菌斑
E. 牙石

正确答案：D。非附着性龈下菌斑

解析：非附着性菌斑：龈缘以下位于附着性龈下菌斑的表面或直接与龈沟上皮、袋内上皮接触的龈下菌斑，为结构较松散的菌群，主要为革兰阴性厌氧菌，如牙龈卟啉单胞菌、福赛坦菌和具核梭杆菌等，还包括许多能动菌和螺旋体。在牙周炎快速进展时，非附着龈下菌斑明显增多，毒力增强，与牙槽骨的快速破坏有关，与牙周炎的发生发展关系密切，被认为是牙周炎的“进展前沿”。掌握“牙周炎病因学”知识点。